某药物按一级速率过程消除，消除速率常数k=0.095h⁻¹，则该药物消除半衰期约为
A. 8.0h
B. 7.3h
C. 5.5h
D. 4.0h
E. 3.7h

正确答案：B。7.3h

解析：本题考查一级动力学消除。按照一级消除动力学过程消除的药物，其半衰期公式为：t1/2=0.693/k，可知，t1/2=0.693/0.095=7.3h（B对）。